一位诊断为慢性牙周炎的牙周病患者，已于2个月前完成牙周基础治疗，现需选择最佳手术方法：右上6颊侧根分叉病变2度，且部分根分叉暴露，附着龈较窄，应选择
A. 根向复位瓣术
B. 牙周袋搔刮术
C. 牙龈切除术
D. 植骨术
E. 引导性组织再生术

正确答案：A。根向复位瓣术

解析：本题考查牙周病的手术治疗。牙周基础治疗后2个月，若右上6颊侧根分叉病变2度，且部分根分叉暴露，附着龈较窄者应选择根向复位瓣术（A对），适用于牙周袋底超过膜龈联合界者以及因根分叉病变暴露根分叉而角化龈过窄者。牙周袋搔刮术（B错）适用于深牙周袋的治疗，当根分叉病变2度时不宜选用。牙龈切除术（C错）是用手术方法切除增生肥大的牙龈，当根分叉病变2度时不宜选用。植骨术（D错）适用于二壁及三壁骨下袋，或Ⅱ度根分叉病变，牙龈瓣能覆盖骨面及根分叉区者，当部分根分叉暴露，附着龈较窄时不宜选用。引导性组织再生术（E错）适用于Ⅱ度根分叉病变，但需有足够的牙龈高度，故当部分根分叉暴露，附着龈较窄时不宜选用。